某男性，煤矿采煤工，年龄45岁，工龄10年以上。近来主诉咳嗽、胸痛、气短。X线胸片呈肺纹理增加，伴有块状阴影和结节。此工人最可能患何种尘肺
A. 石棉肺
B. 硅酸盐肺
C. 煤矽肺
D. 尘肺
E. 铝肺

正确答案：C。煤矽肺

解析：本题考查煤矽肺的概念。煤矽肺（C对ABDE错）是指既在岩石掘进工作面也在采煤工作面工作过的工人因接触煤矽尘或既接触矽尘又接触过煤尘而导致的尘肺。本题中工人在煤矿厂当采矿工，其职业史、接触史、工龄、症状符合煤矽肺的诊断标准，因此被诊断为煤矽肺。